下列哪项不是提高问卷回收率的方法
A. 争取权威机构的支持，以其名义发放问卷，较易引起重视
B. 注重调查员的培训
C. 让调查对象事先了解研究的目的和意义
D. 注意等级答案的明确性
E. 赠送纪念品

正确答案：D。注意等级答案的明确性

解析：本题考查调查问卷。注意等级答案的明确性（D错，为本题正确答案）不是提高问卷回收率的方法。提高回收率的方法有多种，常用的有：1.版面设计简洁、美观且容易阅读。2.问卷问题数量合适且容易回答，最好采用打勾、画圈等选择形式。3.争取权威机构的支持，以其名义发放问卷，较易引起重视（A对）。4.让调查对象事先对研究的目的和意义有所了解（C对），从而更愿意接受调查。5.方便调查对象。例如：在邮寄调查时夹寄一个填写好并贴足邮资的回函信封。6.注重调查员的培训（B对）。调查员良好素质与访谈技巧能提高回复率。7.赠送纪念品（E对）以表明调查者要求配合的恳切希望，并表达谢意。